属于周期性的是
A. 2017年6月台湾省某市某小学和中学共169名学生发生食物中毒
B. 我国北方地区流行性乙型脑炎发病高峰在夏秋季
C. 1965年前我国大中城市人群中麻疹每隔一年流行一次
D. 近年来，猩红热的发病率与死亡率均有明显下降
E. 细菌性痢疾多见于夏秋季

正确答案：C。1965年前我国大中城市人群中麻疹每隔一年流行一次

解析：本题考查疾病的周期性。疾病的周期性是指疾病频率按照一定的时间间隔，有规律地起伏波动，每隔若干年出现一个流行高峰的现象。疾病的周期性的变化多见于呼吸道传染病，流行性感冒﹑流行性脑脊髓膜炎、百日咳、水痘等有周期性现象。主要是由于易感者积累使人群易感性增加，形成发病率增高的现象，如1965年前我国大中城市人群中麻疹每隔一年流行一次（C对ABDE错）。